根据国家药品监督管理部门对药品委托生产管理的相关规定，下列品种可以委托加工的是
A. 葡萄糖氯化钠注射液
B. 吗啡阿托品注射液
C. 布托啡诺注射液
D. 白蛋白注射液

正确答案：A。葡萄糖氯化钠注射液

解析：本题考查的是药品委托生产。根据国家药品监督管理部门对药品委托生产管理的相关规定，下列品种可以委托加工的是葡萄糖氯化钠注射液（A对）。药品上市许可持有人应依法自行生产或委托生产药品：上市许可持有人自行生产药品的，应当依照《药品管理法》规定取得药品生产许可证；委托生产的，应当委托符合条件的药品生产企业。药品上市许可持有人和受托生产企业应当签订委托协议和质量协议，并严格履行协议约定的义务。血液制品、麻醉药品、精神药品、医疗用毒性药品、药品类易制毒化学品不得委托生产；但是，国务院药品监督管理部门另有规定的除外。吗啡阿托品注射液（B错）属于麻醉药品、布托啡诺注射液（C错）属于精神药品、白蛋白注射液（D错）属于血液制品，均不能委托生产。